系统性红斑狼疮气营热盛证的治法是
A. 清热解毒，凉血化斑
B. 养阴清热
C. 清热凉血，活血散瘀
D. 益气养血
E. 疏肝清热，凉血活血

正确答案：A。清热解毒，凉血化斑

解析：系统性红斑狼疮气营热盛证的机理为热毒壅滞脉络，迫血妄行，血溢于肌腠之间，故其治法是清热解毒，凉血化斑（A对），方用凉血解毒的清瘟败毒饮加减。养阴清热（B错）用于肝肾阴虚内热证；清热凉血，活血散瘀（C错）治疗瘀热痹阻证，方用犀角地黄汤加减；益气养血（D错）治疗气血两虚证，方药用八珍汤加减；疏肝清热，凉血活血（E错）治疗热郁积饮证，方药用葶苈大枣泻肺汤合泻白散加减。